牙冠修复体的邻面与邻牙紧密接触的目的不是为了
A. 防止食物嵌塞
B. 维持牙位、牙弓形态的稳定
C. 与邻牙相互支持、分散（牙合）力
D. 保持每个牙各区的生理运动
E. 防止对（牙合）牙伸长

正确答案：E。防止对（牙合）牙伸长

解析：牙冠修复体的邻面与邻牙紧密接触的目的是防止食物嵌塞、维持牙位、牙弓形态的稳定、保持每个牙各区的生理运动、与邻牙相互支持、分散（牙合）力不能防止对（牙合）牙伸长。掌握“修复体试戴、磨光与粘固”知识点。